对一种疫苗效果进行双盲研究是指
A. 设计者和观察者都不知道哪些受试者接受疫苗，哪些受试者接受安慰剂
B. 受试者和观察者都不知道哪些受试者接受疫苗，哪些受试者接受安慰剂
C. 受试者和设计者都不知道哪些受试者接受疫苗，哪些受试者接受安慰剂
D. 观察者和受试者都不知道什么疫苗
E. 观察者和受试者都不知道安慰剂的性质

正确答案：B。受试者和观察者都不知道哪些受试者接受疫苗，哪些受试者接受安慰剂

解析：本题考查双盲的概念。双盲指研究对象和研究实施人员都不了解试验分组情况（B对ACDE错），而是由研究设计者来安排和控制全部试验。